按有机化学的分类，醌类化合物是
A. 不饱和酮类化合物
B. 不饱和酸类化合物
C. 不饱和醛类化合物
D. 多元醇类化合物
E. 多元酸类化合物

正确答案：A。不饱和酮类化合物